下述诸肌哪块不属上肢带肌
A. 冈上肌
B. 冈下肌
C. 大圆肌
D. 小圆肌
E. 喙肱肌

正确答案：E。喙肱肌

解析：冈上肌（A对）、冈下肌（B对）、大圆肌（C对）和小圆肌（D对）都属于上肢带肌，而喙肱肌（E错，为本题正确答案）属于臂肌，而非上肢带肌。